男，24岁。浸润性肺结核患者。使用“异烟肼、利福平、吡嗪酰胺、乙胺丁醇”四联抗结核治疗。治疗过程中患者双手及双足麻木感。首先应采取的措施是
A. 加用维生素B6
B. 停用乙酰丁醇
C. 停用利福平
D. 停用吡嗪酰胺
E. 停用异烟肼

正确答案：A。加用维生素B6

解析：使用“异烟肼、利福平、吡嗪酰胺、乙胺丁醇”四联抗结核治疗的患者出现双手及双足麻木感（周围神经炎症状），最可能为异烟肼的不良反应，首先应采取的措施是加用维生素B6（A对）。